Dane颗粒是
A. 甲型肝炎病毒体
B. 乙型肝炎病毒体
C. 流感病毒体
D. EB病毒体
E. 脊髓灰质炎病毒体

正确答案：B。乙型肝炎病毒体

解析：Dane在乙型肝炎病毒感染者的血清中发现，故称为Dane（丹氏）颗粒。掌握“乙型肝炎病毒”知识点。